人体氟最主要的来源是
A. 空气
B. 饮水
C. 植物性食物
D. 动物性食物
E. 氟化物的局部应用

正确答案：B。饮水

解析：本题考查人体氟来源。人体氟最主要的来源是饮水（B对）。人体氟来源：1.饮水：人体氟的主要来源是饮水，约占人体氟来源的65%。水中氟很容易被吸收。机体从饮水中摄入氟量的多少直接受到饮水氟浓度和饮水量的调控。饮水摄入量又与个体的年龄、生活习惯及当地的气温等因素有关，12岁以前的饮水量约占液体总摄入量的50%，成人饮水量每日约2500～3000mL。热带地区饮水量显著大于严寒地区。2.食物（CD错）：人体每天摄入的氟约有25%来自于食品。所有食品，包括植物或动物食品中都含有一定量的氟，但差异很大。3.空气（A错）：虽然空气中的氟不是人体氟的主要来源，但在某些特殊环境条件下可引起空气氟污染，这样，空气中的氟可通过呼吸道进入人体，造成机体氟中毒。4.其他可能的氟来源：某些口腔局部用氟产品（E错）的氟浓度很高，如果不在医师指导下适量应用，可导致机体氟摄入量增高。